关于制剂新技术特点与应用的说法，错误的是
A. 固体分散体常用乙基纤维素增加难溶性药物的溶出速度
B. 环糊精包合可提高药物的稳定性
C. 环糊精包合可掩盖药物不良气味
D. 制成微囊可改善药物的流动性、可压性等物理特性
E. 固体分散体久贮可能出现药物晶型改变等老化现象

正确答案：A。固体分散体常用乙基纤维素增加难溶性药物的溶出速度

解析：本题考查的是中药制剂新技术。关于制剂新技术特点与应用的说法错误的是固体分散体常用乙基纤维素延缓或控制药物释放（A错，为本题正确答案）。固体分散体具备如下特点：①达到不同的释药目的：利用亲水性高分子载体材料增加难溶性药物的溶解度和溶出度，提高药物的生物利用度；利用难溶性高分子载体材料延缓或控制药物释放；利用肠溶性高分子载体材料控制药物于小肠或结肠定位释放。②延缓药物的水解和氧化。③掩盖药物的不良气味和刺激性。④使液体药物固体化。固体分散体的主要缺点是久贮可能出现药物晶型改变、重结晶、结晶粗化和药物溶出度降低等老化现象（E对），在一定程度上影响了固体分散体的临床应用。固体分散体的常用难溶性载体材料：常用的有纤维素衍生物（如乙基纤维素）、聚丙烯酸树脂类、脂类（如胆固醇、β-谷甾醇）等。这类载体材料难溶于水，常被作为缓释、控释型固体分散体的载体。环糊精包合物的作用：①提高药物的稳定性（B对）。②增加药物的溶解度。③减少药物的刺激性，掩盖不良臭味（C对）。④调节药物的释放速度。⑤使液体药物粉末化而便于制剂。药物微囊化后可提高稳定性，掩盖不良臭味，降低在胃肠道中的副作用，减少复方配伍禁忌，延缓或控制药物释放，改进某些药物的物理特性（D对），如流动性、可压性以及可将液体药物制成固体制剂。